男，50岁。劳累时胸痛2年，每于上3层楼梯时症状发作，含服硝酸甘油1～3分钟可缓解。既往高血压病史5年，糖尿病病史4年。可改善该患者预后的治疗措施是
A. 冠状动脉支架植入术
B. 皮下注射低分子肝素
C. 长期口服营养心肌类药物
D. 冠状动脉旁路移植术
E. 长期口服他汀类药物

正确答案：E。长期口服他汀类药物

解析：患者中老年男性，劳累时出现胸痛，含服硝酸甘油1～3分钟可缓解，并有高血压、糖尿病史，考虑诊断为稳定型心绞痛。目前可预防心肌梗死、改善患者预后的药物包括阿司匹林、氯吡格雷、β受体拮抗剂、他汀类药物（E对）和ACEI或ARB（P226）。冠状动脉支架植入术（A错）和冠状动脉旁路移植术（D错）为血管重建治疗，虽能使患者生活质量提高但心肌梗死的发生率和死亡率并无异，且风险较大。皮下注射低分子肝素（P233）（B错）主要用于急性冠脉综合症的抗凝治疗，对改善患者预后无多大效果。长期口服营养心肌类药物（C错）可改善心肌的代谢，但对改善患者的预后也无多大效果。